外源化学物经消化道吸收的主要方式是
A. 通过营养物质作为载体
B. 滤过
C. 简单扩散
D. 载体扩散

正确答案：C。简单扩散

解析：本题考查外源化学物经消化道吸收的主要方式。简单扩散（C对ABD错）又称脂溶扩散，是大多数化学毒物通过生物膜的方式，也是外源化学物经消化道吸收的主要方式。